某女，68岁。素患青光眼，刻下心悸不安，胸闷气短，动则尤甚，面色苍白，形寒肢冷，下肢浮肿，夜间不能平卧；舌淡苔白，脉虚弱。诊断为心悸。四诊合参，辨析其证候是
A. 心脾两虚
B. 阴虚火旺
C. 心阳不振
D. 瘀阻心脉
E. 痰浊痹阻

正确答案：C。心阳不振

解析：本题考查心悸之心阳不振证的症状。结合患者症状为心悸之心阳不振证（C对）。心悸之心阳不振证【症状】心悸不安，胸闷气短，动则尤甚，面色苍白，形寒肢冷。舌淡苔白，脉虚弱或沉细无力。心悸之心脾两虚证（A错）【症状】心悸气短，头晕目眩，失眠健忘，面色无华，倦怠乏力，纳呆食少。舌淡红，脉细弱。心悸之阴虚火旺证（B错）【症状】心悸易惊，心烦失眠，五心烦热，口干，盗汗，思虑劳心则症状加重，伴耳鸣腰酸，头晕目眩，急躁易怒。舌红少津，苔少或无，脉细数。心悸之瘀阻心脉证（D错）【症状】心悸不安，胸闷不舒，心痛时作，痛如针刺，唇甲青紫。舌质紫暗或有瘀斑，脉涩或结或代。胸痹之痰浊痹阻（E错）证【症状】胸闷重而心痛微，痰多气短，肢体沉重，形体肥胖，遇阴雨天而易发作或加重，伴有倦怠乏力，纳呆便溏，咳吐痰涎。舌体胖大且边有齿痕，苔浊腻或白滑，脉滑。